患者，女,69岁，左胸部闷痛4年，近来胸闷频发，痰多气短，肢体沉重，形体肥胖，偶有心悸眩晕，纳呆便溏，咯吐痰涎，舌体胖大边有齿痕，苔白腻，脉滑，其辩证是
A. 气滞心胸证
B. 寒凝心脉证
C. 痰浊闭阻证
D. 心肾阳虚证
E. 心血瘀阻证

正确答案：C。痰浊闭阻证

解析：此患者中医诊断为胸痹，分七个证型，除了选项的五个证型，还有气阴两虚证、心肾阴虚证。患者痰多气短，肢体沉重，形体肥胖，偶有心悸眩晕，纳呆便溏，咯吐痰涎，舌体胖大边有齿痕，苔白腻，脉滑，全为痰浊闭组表现（C对）。